从结合上皮的冠方延伸到游离龈的顶部，为薄的非角化复层鳞状上皮
A. 结合上皮
B. 龈沟上皮
C. 牙龈上皮
D. 缩余釉上皮
E. 龈谷上皮

正确答案：B。龈沟上皮

解析：沟内上皮又称为龈沟上皮，为牙龈沟的衬里上皮。龈沟上皮从结合上皮的冠方延伸到游离龈的顶部，为薄的非角化复层鳞状上皮。掌握“牙龈”知识点。